患者，女，50岁。现症见左侧半身偏枯不用，肢体软弱无力，面色萎黄，有时肢体麻木不仁，舌淡紫，苔薄白，脉细涩无力。治疗应首选
A. 三痹汤
B. 黄芪桂枝五物汤
C. 桃红饮
D. 补阳还五汤
E. 当归四逆汤

正确答案：D。补阳还五汤

解析：本题患者为痿证，由于气虚不能运血，气不能行，血不能荣，气血瘀滞，脉络痹阻，而致左侧半身偏枯不用，肢体软弱无力。因气虚，则见舌色淡，脉无力。气血虚不能上荣于面，则面色萎黄。痰浊停聚或流窜经络，气血运行不畅，则见肢体麻木不仁，舌质紫脉细涩为血瘀之象，宜用具有补气活血通络功效，用于气虚血瘀所致的半身不遂的补阳还五汤（D对）；三痹汤具有益气养血，祛风胜湿功效，用于血气凝滞证（A错）；黄芪桂枝五物汤具有益气温经，和经通痹功效，用于血痹证（B错）；桃红饮具有活血化瘀功效，用于瘀血内阻证（C错）；当归四逆汤具有温经散寒，养血通脉功效，用于阳虚寒凝血脉证（E错）。